生物―心理―社会医学模式建立在20世纪的
A. 50年代
B. 60年代
C. 70年代
D. 80年代
E. 90年代

正确答案：C。70年代

解析：迄今为止，出现过三种医学模式，即：古代朴素的整体医学模式、近代生物医学模式和现代生物-心理-社会医学模式。生物-心理-社会医学模式是20世纪70年代（C对）以后建立起来的，它从生物、心理、社会等综合因素全面认识健康和疾病。生物-心理-社会医学模式的建立，不仅反映着医学的发展，而且呼唤着医德的进步。